属于可摘局部义齿塑料基托的缺点的是
A. 色泽美观
B. 操作简便
C. 容易自洁
D. 温度传导作用差
E. 便于修理、添加和重衬

正确答案：D。温度传导作用差

解析：塑料基托：材料为甲基丙烯酸甲酯。优点：色泽美观，近似黏膜，操作简便，价廉，重量轻，便于修理、添加和重衬。缺点：强度差，受力大时易折裂；温度传导作用差，且不易自洁。掌握“局部义齿人工牙及基托”知识点。